根据《中华人民共和国药品管理法》对药品的广告宣传的规定，下列说法正确的是
A. 说明药品的适应症和功能主治
B. 利用患者介绍药品的作用
C. 资助电视健康节目并在期间做不定期宣传
D. 宣传与某大学的研究机构合作研究开发
E. 利用演员等公众人物作宣传

正确答案：A。说明药品的适应症和功能主治

解析：本题考查药品广告发布的内容准则。根据《中华人民共和国药品管理法》对药品的广告宣传的规定，下列说法正确的是说明药品的适应症和功能主治（A对）。药品广告的内容应当以国务院药品监督管理部门核准的说明书为准。药品广告涉及药品名称、药品适应症或者功能主治、药理作用等内容的，不得超出说明书范围。药品广告中不得出现使用科研单位、学术机构，、行业协会或者专家、学者、医师、药师、临床营养师、患者等的名义或者形象作推荐、证明（D错）。广播电台、电视台、报刊音像出版单位、互联网信息服务提供者不得以介绍健康、养生知识等形式变相发布医疗、药品、医疗器械、保健食品广告（C错）。